研究化学结构与毒性效应之间关系的目的是
A. 寻找毒作用的规律，有助于通过比较，预测新化合物的生物活性
B. 预测毒性的大小
C. 推测毒作用机理
D. 以上都是

正确答案：D。以上都是

解析：本题考查研究化学结构与毒性效应之间关系的目的。研究化学结构与毒性效应之间关系的目的是：1.寻找毒作用的规律，有助于通过比较，预测新化合物的生物活性；2.预测毒性的大小；3.推测毒作用机理（D对ABC错）。